医生在于慢性病患者的沟通中，医患关系最理想的模式为
A. 共同-参与
B. 被动-被动
C. 主动-被动
D. 指导-合作
E. 主动-主动

正确答案：A。共同-参与

解析：慢性病患者，医生指导用药，医生担任的责任是帮助患者自疗，此医患模式为共同参与（A对）。主动－被动模式（C错），在这种模式中，医患双方不是双向作用，而是医生对患者单向发生作用。指导－合作模式（D错），在这种模式中，患者被看作有意识、有思想的人，具有一定的主动性，能够主动述说病情，反映诊治情况，配合检查和治疗。